患者左上后牙因龋充填后3周自发钝痛，与温度无关，咬合痛。查：左上6近中邻（牙合）面充填物完好，无高点。可能原因为
A. 药物烧伤
B. 充填体悬突
C. 食物嵌塞
D. 流电作用
E. 充填材料刺激

正确答案：B。充填体悬突

解析：本题考查充填后疼痛。患者左上后牙因龋充填后3周自发钝痛，与温度无关，咬合痛。查：左上6近中邻（牙合）面充填物完好，无高点。可能原因为充填体悬突（B对）。根据病例描述，左上后牙因龋充填后3周自发钝痛，与温度无关，咬合痛，考虑为牙周性疼痛。术中酸蚀剂等药物溢至牙龈导致的药物烧伤，一般在术后即会出现疼痛，不会在3周后才出现（A错）。患牙为邻（牙合）面充填，可能因充填物在龈缘形成悬突，长期压迫牙龈，导致自发性钝痛。接触点恢复不良，可造成食物嵌塞，引起牙龈炎症，病例中未诉患牙有食物嵌塞的情况，暂不考虑食物嵌塞的因素（C错）。流电作用主要表现为短期内与对颌牙接触时疼痛，脱离接触后疼痛消失，不会有自发性钝痛（D错）。充填材料刺激主要引起远期的牙髓性疼痛，其疼痛与温度刺激有关（E错）。